下列关于实的叙述，错误的是
A. 外感邪盛
B. 肌肤经络闭塞
C. 气机升降失调
D. 脏腑功能亢进
E. 气血壅滞瘀结

正确答案：C。气机升降失调

解析：实指邪气盛，指以邪气亢盛为矛盾主要方面的病机变化。发病后，邪气的致病力强盛，而正气的抗病能力未衰，能积极与邪抗争，故正邪斗争激烈，反应明显，临床上出现一系列病变反应比较剧烈的、亢盛有余的证候，称为实证。外感邪盛为邪气亢盛，符合实的叙述（A对）；肌肤经络闭塞、脏腑功能亢进、气血壅滞瘀结均为实证的表现（BDE对）；气机升降失调不属于邪气盛的表现（C错，为本题正确答案）。